薤白辛散温通，苦泄滑利，善散阴寒之凝结，其主治病证是
A. 肝胃不和之脘痛
B. 痰浊闭阻之胸痹
C. 肝郁气滞之助痛
D. 痰湿壅肺之咳喘
E. 寒凝血瘀之胸腹刺痛

正确答案：B。痰浊闭阻之胸痹

解析：本题考查的是薤白的主治病证。薤白辛散温通，苦泄滑利，善散阴寒之凝结，其主治病证是痰浊闭阻之胸痹（B对）。薤白【主治病证】（1）痰浊闭阻胸阳之胸痹证。（2）胃肠气滞，泻痢里急后重。荔枝核【主治病证】（1）寒疝腹痛，睾丸肿痛。（2）痛经，产后腹痛。（3）肝胃不和之胃脘痛（A错）。佛手【主治病证】（1）肝郁气滞胸闷胁痛（C错）。（2）脾胃气滞之脘腹胀痛。（3）咳嗽痰多。陈皮【主治病证】（1）脾胃气滞之脘腹胀满或疼痛、嗳气、恶心呕吐。（2）湿浊中阻之胸闷腹胀、纳呆便溏。（3）痰湿壅肺之咳嗽气喘（D错）。姜黄辛温行散，以治寒凝血瘀气滞（E错）之证为好，又能通经、散风寒湿，善走肢臂，治上肢肩臂之风寒湿痹、跌打损伤之瘀血肿痛；外用治痫肿疮毒。